宫颈癌临床分期Ⅱa是指
A. 癌累及阴道，未达阴道下1/3段，无明显宫旁浸润
B. 癌累及宫旁，无明显阴道浸润
C. 肉眼可见癌灶虽位于宫颈，但体积＞4cm³
D. 癌累及阴道下1/3段，无明显宫旁浸润
E. 癌累及宫旁，间质浸润深度3～5mm

正确答案：A。癌累及阴道，未达阴道下1/3段，无明显宫旁浸润

解析：宫颈癌临床分期ⅡA是指癌累及阴道，未达阴道下1/3段，无明显宫旁浸润（A对）。癌累及宫旁，间质浸润深度3～5mm（E错）和癌累及宫旁，无明显阴道浸润（B错）均为ⅡB期；肉眼可见癌灶虽位于宫颈，但体积＞4cm（C错）为ⅠB期；癌累及阴道下1/3段，无明显宫旁浸润（D错）为ⅢA期。